患者仅出现面瘫+味觉丧失+唾液腺分泌障碍，面神经的损害可能位于
A. 茎乳孔以外
B. 鼓索与镫骨肌神经节之间
C. 镫骨肌与膝状神经节之间
D. 膝状神经节
E. 脑桥与膝状神经节之间

正确答案：B。鼓索与镫骨肌神经节之间

解析：本题考查面神经麻痹的诊断。患者仅出现面瘫+味觉丧失+唾液腺分泌障碍，面神经的损害可能位于鼓索与镫骨肌神经节之间（B对）。损害发生的部位可影响面瘫的症状，根据味觉、听觉及泪液检查结果，可明确面神经损害的部位，从而做出相应的损害定位诊断：1.茎乳孔以外（A错）：面瘫。2.鼓索与镫骨肌神经节之间：面瘫+味觉丧失+唾液腺分泌障碍。3.镫骨肌与膝状神经节之间（C错）：面瘫+味觉丧失+唾液腺分泌障碍+听觉改变。4.膝状神经节（D错）：面瘫+味觉丧失+唾液腺、泪腺分泌障碍+听觉改变。5.脑桥与膝状神经节之间（E错）：除面瘫外，感觉与分泌功能障碍一般均较轻，如损害影响听神经时，尚可发生耳鸣、眩晕。6.核性损害：面瘫+轻度感觉与分泌障碍，但往往影响展神经核而发生该神经的麻痹，若损害累及皮质延髓束时可发生对侧偏瘫。